早产儿指
A. 胎龄小于28周的新生儿
B. 胎龄小于37周的新生儿
C. 胎龄20周至第37周的新生儿
D. 胎龄28周至第37周的新生儿
E. 胎龄30周至37周的新生儿

正确答案：B。胎龄小于37周的新生儿

解析：根据出生时胎龄分类，早产儿指GA（胎龄）＜37周（＜259天的新生儿）（B对），其中GA＜28周者成为极早早产儿或超未成熟儿。